生用镇惊安神，煅用制酸止痛的是
A. 琥珀
B. 牡蛎
C. 石决明
D. 赭石
E. 海浮石

正确答案：B。牡蛎

解析：本题考查的是牡蛎的性能特点。生用镇惊安神，煅用制酸止痛的是牡蛎（B对）。牡蛎：【性能特点】本品介类质重镇潜，咸软微寒兼补，入肝、肾经，生用、煅用功异。生用质重镇潜，味咸软坚，善平肝潜阳、镇惊安神、软坚散结，并兼益阴，善治阴虚阳亢之眩晕、阴虚动风，以及心悸失眠，瘰疬痰核诸证。煅用性涩收敛，善收敛固涩、制酸止痛，治滑脱诸证，胃痛泛酸。琥珀（A错）：【性能特点】本品重镇行散，甘淡渗利，平而偏凉。入心、肝经，善安神定惊、活血散瘀，既治惊悸失眠、惊风癫痫，又疗血滞闭经、癥瘕积聚；入膀胱经，能利尿通淋，治小便不利、癃闭诸证。石决明（C错）：【性能特点】本品介类质重镇潜，咸寒清泄兼补，专入肝经，略兼滋阴。善平肝潜阳、清肝明目，为治肝阳上亢及肝热目疾之要药。赭石（D错）：【性能特点】本品质重镇潜，苦寒清降。入肝经，善镇潜平肝，治肝阳上亢。入肺、胃经，善降肺胃之逆，治呕呃喘息。入心经，善凉血止血，治血热气逆之吐衄。海浮石（E错）：【性能特点】本品咸软寒清，质轻上浮，专入肺经。善清肺化痰，为治痰热咳喘之要药；能软坚散结，为治瘰疬结核所常用；兼通淋，可治淋证涩痛。